某幼儿园进行乳牙的龋病流行调查，在100名6岁以下儿童群体中，出现的龋病的儿童有80个，患龋率达到80%，造成儿童易患龋的因素的说法，不正确的是
A. 乳牙牙颈部明显缩窄，可以成为不洁区
B. 组织结构中的矿化程度较恒牙低，抗酸力弱
C. 咀嚼功能差，食物的黏着性较强
D. 比较自觉的维持口腔卫生
E. 家长较重视程度较低，成为致龋的因素

正确答案：D。比较自觉的维持口腔卫生

解析：本题考查乳牙易患龋的因素。造成儿童易患龋的因素的说法不正确的是比较自觉的维持口腔卫生（D错，为本题正确答案）。儿童不能自觉进行口腔卫生保健，口腔卫生差，儿童饮食常含有糖而且有些小朋友常在刷牙后吃零食，这些因素易导致龋病。乳牙易患龋的因素主要有：1.形态解剖特点：乳牙牙颈部明显收缩，牙冠近颈1/3处隆起以及冠部的点隙与裂沟，均易滞留菌斑和食物残渣，成为不洁区（A对）。2.组织结构特点：乳牙的矿化程度较恒牙低，抗酸力弱，牙釉质、牙本质薄，易发生龋（B对）。3.儿童饮食特点：幼儿咀嚼功能差，以流食或半流食为主，且甜食多，这些食物致龋力强且易附着于牙面，容易导致乳牙龋齿的发生（C对）。4.口腔自洁和清洁作用差：儿童较难自觉地维护口腔卫生，家长也往往不够重视，加上口腔处于静止状态的时间也较长，有利于细菌繁殖，成为致龋的因素(E对）。